某纺织女工，30岁，接触棉尘5年。近3个月，每逢厂休息日后第一天上班日的下班前有胸部紧束感、气急、咳嗽、发热症状，该工人所患疾病可能是
A. 感冒
B. 支气管炎
C. 棉尘症
D. 棉尘病
E. 肺结核

正确答案：D。棉尘病